男，52岁。初诊2型糖尿病2个月，每天进主食量约500g，身高171cm。体重90kg，BMI30.8。查空腹血糖5.8mmol/L，餐后2小时血糖12.8mmol/L，糖化血红蛋白7.2%。目前治疗不宜选择降血糖的药物是
A. 磺脲类
B. α-葡萄糖苷酶抑制剂
C. 噻唑烷二酮类
D. 双胍类
E. 格列奈类

正确答案：C。噻唑烷二酮类

解析：中年男性，初诊2型糖尿病，BMI30.8（BMI≥28kg/m²2为肥胖），空腹血糖5.5mmol/L（空腹血糖＜6.1mmol/L，为正常血糖），餐后2小时血糖12.8mmol/L（餐后2小时血糖＜7.8mmol/L，为正常血糖），糖化血红蛋白7.2%（HbA1c≥6.5%，提示糖尿病）。综合患者的病史、体征及实验室检查，可诊断患者为肥胖的2型糖尿病，餐后血糖增高。因此可选用双胍类（D对）（治疗2型糖尿病的一线药物）、磺脲类（A对）（虽然磺脲类主要用于非肥胖的2型糖尿病，但对肥胖的2型糖尿病也有一定的效果）、а-葡萄糖苷酶抑制剂（B对）（可控制餐后血糖）和格列奈类（E对）（较适合于T2DM早期餐后高血糖阶段或以餐后高血糖为主的老年患者）。噻唑烷二酮类（C错，为本题正确答案）虽然可用于治疗肥胖的2型糖尿病，但由于该类药物的常见副作用是体重增加和水肿，而且常用药物罗格列酮的使用会增加心血管事件的发病率，加上我国对此类药物的应用有着严格的限制，故并不宜选用作为该患者的降糖药物。